男孩，6岁，咳嗽伴喘息1天，无发热。既往有反复喘息发作4～5次。其外祖父患有支气管哮喘。查体：呼吸急促，可见轻度三凹征，呼气相延长，双肺满布哮鸣音。目前应首选的治疗是
A. 吸入沙丁胺醇
B. 口服白三烯调节剂
C. 口服西替利嗪
D. 静脉注射地塞米松
E. 静脉滴注青霉素

正确答案：A。吸入沙丁胺醇

解析：6岁男性患儿，咳嗽伴喘息1天，无发热（提示无感染征象）。既往有反复喘息发作4～5次（支气管哮喘发作病史）。其外祖父患有支气管哮喘（有遗传病史）。查体：呼吸急促，可见轻度三凹征，呼气相延长（提示呼气困难），双肺满布哮鸣音。根据患儿病史、体征，考虑诊断为支气管哮喘急性发作。支气管哮喘急性发作时应首选吸入速效β₂受体激动剂（A对）。口服白三烯调节剂（B错）应用于长期治疗，排除。西替利嗪（C错）属于组胺H1受体拮抗剂，用于过敏。静脉注射地塞米松（D错）用于危重哮喘。患者无感染，故不选静脉滴注青霉素（E错）。